下列中药中呈丝状缠绕成团，地衣体呈二叉状分枝粗枝表面有明显的环装裂纹的药材是
A. 茯苓
B. 松萝
C. 海藻
D. 猪苓
E. 冬虫夏草

正确答案：B。松萝

解析：本题考查的是松萝药材的性状鉴别。下列中药中呈丝状缠绕成团，地衣体呈二叉状分枝粗枝表面有明显的环装裂纹的药材是松萝（B对）。松萝【性状鉴别】松萝地衣体长10～40cm，呈二叉状分枝，基部直径0.8～1.5mm。表面灰绿色或黄绿色，粗枝表面有明显的环状裂纹。质柔韧，略有弹性，不易折断，断面可见中央有线状强韧的中轴。茯苓（A错）：【性状鉴别】药材茯苓个呈类球形、椭圆形、扁圆形或不规则团块，大小不一。外皮薄而粗糙，棕褐色至黑褐色，有明显的皱缩纹理。体重，质坚实，断面颗粒性，有的具裂隙，外层淡棕色，内部白色，少数淡红色，有的中间抱有松根（习称茯神）。气微，味淡，嚼之粘牙。海藻（C错）：【性状鉴别】药材大叶海藻皱缩卷曲，黑褐色，有的被白霜。主干呈圆柱状，具圆锥形突起，主枝自主干两侧生出，侧枝自主枝叶腋生出，具短小的刺状突起。初生叶披针形或倒卵形，全缘或具粗锯齿；次生叶条形或披针形，叶腋间有着生条状叶的小枝。气囊黑褐色，球形或卵圆形，有的有柄，顶端钝圆，有的具细短尖。质脆，潮润时柔软；水浸后膨胀，肉质，黏滑。气腥，味微咸。猪苓（D错）：【性状鉴别】药材呈条形、类圆形或扁块状，有的有分枝。表面黑色、灰黑色或棕黑色，皱缩或有瘤状突起。体轻，质硬，断面类白色或黄白色，略呈颗粒状。气微，味淡。冬虫夏草（E错）：【性状鉴别】药材由虫体与从虫体头部长出的真菌子座相连而成。虫体似蚕；表面深黄色至黄棕色，有20～30条环纹，近头部环纹较细；头部红棕色；足8对，中部4对较明显；质脆，易折断，断面略平坦，淡黄白色。子座细长圆柱形；表面深棕色至棕褐色，有细纵皱纹，上部稍膨大；质柔韧，断面类白色。气微腥，味微苦。